妊娠数月，面浮肢肿，皮薄光亮，按之凹陷，气短懒言，纳呆便溏。其诊断是
A. 脾虚型子肿
B. 湿热型子肿
C. 气滞型子肿
D. 肾虚型子肿
E. 肝郁脾虚型子肿

正确答案：A。脾虚型子肿

解析：患者面浮肢肿，皮薄光亮，按之凹陷是因为素体脾虚，加之妊娠数月，胎体上升阻碍中焦；因机括不利，脾主肌肉四肢，脾阳不运，水湿停聚，浸渍四肢肌肉，面目四肢浮肿，气短懒言，纳少便溏均为脾虚生湿之象（A对）。湿热型子肿多伴有发热，身热不扬，口苦，胸痞，尿黄而短，舌质红，苔黄腻，脉濡数等湿热证候（B错）。气滞型子肿多伴有胸闷胁胀，头晕胀痛，苔薄腻，脉弦滑等气滞证候（C错）。肾虚型子肿多伴有腰酸乏力，下肢逆冷，小便不利，下肢水肿甚等肾虚证候（D错）。肝郁脾虚型子肿多伴有胁肋作痛，情志抑郁，腹胀，便溏等肝郁脾虚证候（E错）。